戊型肝炎病毒的主要传播途径是
A. 血液传播
B. 消化道传播
C. 经呼吸道传播
D. 性接触传播
E. 医源性传播

正确答案：B。消化道传播

解析：戊型肝炎病毒是戊型肝炎的病原体，主要传播途径是消化道传播（B对），经粪-口途径传播，病毒经胃肠道进入血流。经粪-口途径传播的肝炎病毒还有甲型肝炎病毒。可经血液传播（A错）、性接触传播（D错）的肝炎病毒有乙型肝炎病毒、丙型肝炎病毒、丁型肝病毒。各型肝炎病毒传播途径详见表28-1人类肝炎病毒的主要特征（P262）。呼吸道传播（C错）是一些呼吸道病毒的传播途径。医源性传播（E错）可导致医院感染，传播途径有接触传播、血液传播、共同媒介物传播、呼吸道传播、消化道传播（八版传染病学P358）。